未按照《抗菌药物临床应用管理办法》开具抗菌药物处方，造成严重后果的医疗机构应当
A. 警告
B. 经济处罚
C. 取消其处方权
D. 依法追究刑事责任
E. 责令暂停六个月执业活动

正确答案：C。取消其处方权

解析：医师出现下列情形之一的，医疗机构应当取消其处方权：①抗菌药物考核不合格的；②限制处方权后，仍出现超常处方且无正当理由的；③未按照规定开具抗菌药物处方，造成严重后果的；④未按照规定使用抗菌药物，造成严重后果的；⑤开具抗菌药物处方牟取不正当利益的。掌握“抗菌药物临床应用、监督及法律责任”知识点。